银汞合金研磨过度的结果是
A. 收缩
B. 膨胀
C. 先收缩后膨胀
D. 先膨胀后收缩
E. 延缓膨胀

正确答案：A。收缩

解析：本题考查银汞合金的性能。研磨不足或过度研磨以及研磨后拖延充填，均可增加合金的蠕变，合金蠕变增加体积收缩（A对B错），边缘收缩变形、翘起，受力后容易折裂。银汞合金的最终尺寸是膨胀还是收缩在一定程度上取决于最初收缩的程度，如果调和研磨时间过长，最初的收缩很大，以至于随后的膨胀即先收缩后膨胀（CD错）不足于弥补最初的收缩，最终表现为体积收缩。延缓膨胀（E错）指如果银汞合金在调和及充填过程中被潮湿污染，则会产生较大的膨胀，这种膨胀通常发生在充填后的3～5天，可延缓数月，膨胀可达0.4%。